乳剂属热力学不稳定非均相分散体系，其不可逆变化有
A. 分层
B. 絮凝
C. 转相
D. 合并
E. 破裂

正确答案：D、E。合并；破裂

解析：本题考查乳剂。乳剂属热力学不稳定非均相分散体系，其不可逆变化有合并（D对）、破裂（E对）。合并是指乳剂中乳滴周围的乳化膜出现部分破裂导致液滴合并变大的现象。破裂指液滴合并进一步发展，最后使得乳剂形成油相和水相两相的现象。破裂是一个不可逆过程。分层（A错）是乳剂放置后出现分散相粒子上浮或者下沉的现象，分层的乳剂经振摇后仍能恢复成均匀的乳剂。絮凝（B错）是指乳剂中分散相的乳滴发生可逆的聚集现象。转相（C错）是乳剂由于某些条件的变化而改变乳剂的类型，也是可逆的。